中年人心理健康的常见问题不包括
A. 渴望健康与追求成就的矛盾
B. 反应速度与记忆能力下降
C. 人际关系错综复杂
D. 家庭与事业的双趋冲突
E. 主观健康水平评价差

正确答案：E。主观健康水平评价差